根据试验的目的决定试验观察期限，如氟防龋效果观察，至少应持续
A. 半年
B. 2年
C. 4年
D. 6年
E. 10年

正确答案：B。2年

解析：口腔临床试验需要一定的试验周期，一般应该根据试验目的决定试验的观察期限，如氟防龋效果观察，至少应持续2年，一般为2～3年。牙周病预防措施的效果观察可以持续6周～18个月。掌握“口腔临床试验方法”知识点。